恒牙早萌多见于
A. 下颌第一前磨牙
B. 下颌第一磨牙
C. 上颌中切牙
D. 上颌第一磨牙
E. 下颌尖牙

正确答案：A。下颌第一前磨牙

解析：恒牙早萌在前磨牙多见，下颌多于上颌。早萌牙多伴有釉质发育不全。掌握“乳牙滞留和乳牙早萌”知识点。